患者，女，24岁，患有缺铁性贫血并伴有慢性腹泻，实验室检查，HB₅5g/L，血清铁12㎍/L首选的治疗方案是
A. 口服铁剂及维生素
B. 静脉滴注铁剂
C. 注射维生素B
D. 雄性激素治疗
E. 叶酸治疗

正确答案：B。静脉滴注铁剂

解析：本题考查缺铁性贫血。胃肠反应重或经胃肠不能吸收，或需要快速补铁的情况下，可以选择静脉或肌注补铁治疗（B对）。口服铁剂（A错）是治疗缺铁性贫血的首选方法，其最大的缺点是胃肠道不良反应。叶酸（E错）是用于治疗巨幼红细胞性贫血的药物。